职业性肿瘤多见于
A. 皮肤
B. 肝脏
C. 皮肤和肝脏
D. 皮肤和呼吸系统
E. 消化系统

正确答案：D。皮肤和呼吸系统

解析：本题考查职业性肿瘤的好发部位。职业性肿瘤有比较固定的好发部位或范围，多在致癌因素作用最强列、最经常接触的部位发生。由于皮肤和肺是职业致癌物进入机体的主要途径和直接作用的器官，故职业性肿瘤多见于呼吸系统和皮肤（D对ABCE错），并可能累及同一系统的邻近器官，亦可发生在远膈部位，同一致癌物也可能引起不同部位的肿瘤。